流行病学调查表明黄曲霉毒素与人类哪种肿瘤的发生密切相关
A. 结肠癌
B. 胰腺癌
C. 食管癌
D. 胃癌
E. 肝癌

正确答案：E。肝癌